有关腹壁下动脉的描述，正确的是
A. 发自髂外动脉
B. 经过腹环外侧
C. 于半环线处入腹直肌鞘
D. 行于腹横筋膜与腹横肌之间
E. 输精管由其内侧绕过

正确答案：A。发自髂外动脉

解析：腹壁下动脉发自髂外动脉（A对），其进入腹直肌鞘，与腹壁上动脉吻合并分布于腹直肌。